涂层的影响有
A. 利于粘接剂在牙面的润湿和渗入
B. 增加修复体与洞壁的密合性
C. 形成管塞减少了牙本质小管液的外溢
D. A和B
E. A、B、C三项

正确答案：E。A、B、C三项

解析：本题考查涂层的影响。应用涂层的目的就是为了利于粘结剂在牙面的润湿和渗入（A对），再加上洞壁有时候不是很规则，使用涂层可以增加修复体与洞壁的密合性（B对），从而提高粘接效果。牙体预备时对牙齿的磨切会使牙本质小管暴露，导致小管液的外溢，还有可能导致牙齿敏感，使用涂层渗入开发的牙本质小管中，可以形成管塞减少了牙本质小管液的外溢（C对）和牙本质敏感（ABC均对，故E为本题的正确答案）。